1周岁小儿的胸围应约为
A. 34cm
B. 38cm
C. 42cm
D. 46cm
E. 50cm

正确答案：D。46cm

解析：本题为记忆题。小儿出生时胸围32cm，略小于头围1～2cm；1岁左右胸围等于头围，为46cm（D对）。